男性，12岁。误服有机磷农药1605（对硫磷）一口，急送医院就诊，当时测定胆碱酯酶活力为54%。对该患者应用了氯解磷定静脉滴注治疗，其目的为
A. 减少毒物吸收
B. 恢复胆碱酯酶活力
C. 预防脑水肿
D. 对抗烟碱样症状
E. 对抗毒蕈碱样症状

正确答案：B。恢复胆碱酯酶活力